不能抵抗机械力，易破裂，且结缔组织中常见不同程度的炎细胞浸润，且位于龈沟的内侧壁的上皮为
A. 结合上皮
B. 牙龈上皮
C. 龈沟上皮
D. 附着龈
E. 龈谷上皮

正确答案：C。龈沟上皮

解析：龈沟上皮为龈沟的内侧上皮，不能抵抗机械力，易破裂。结缔组织中常见不同程度的炎性细胞浸润，这是由于龈沟内食物分解产物和细菌的刺激所引起的。掌握“牙龈”知识点。